下列传导束中不传递身体对侧感觉冲动的有
A. 脊髓丘脑前束
B. 脊髓丘脑侧束
C. 脊髓小脑前束
D. 脊髓小脑后束
E. 内侧丘系

正确答案：D。脊髓小脑后束

解析：躯干和四肢痛温觉、粗略触觉和压觉传导通路中，第二级神经元发出纤维交叉至对侧，组成脊髓丘脑侧束（B对）和脊髓丘脑前束（A对）躯干和四肢非意识性本体感觉传导通路中，第2级纤维在同侧脊髓侧索组成脊髓小脑后束（D错，为本题正确选项），腰骶膨大第 V-VII 层外侧部发出的第2级纤维组成对侧和同侧的脊髓小脑前束（C对）。